在突发公共卫生事件发生的最初，最紧迫的任务是
A. 医疗救治
B. 心理援助
C. 环境卫生处理
D. 卫生知识宣传和风险沟通
E. 加强食品卫生、饮用水卫生和公共场所卫生监督监测工作

正确答案：A。医疗救治